与氢氯噻嗪合用可以防止低血钾的药物是
A. 异烟肼
B. 亚胺培南
C. 沙丁胺醇
D. 阿莫西林
E. 氨苯蝶啶

正确答案：E。氨苯蝶啶

解析：本题考查药物的相互作用。与氢氯噻嗪合用可以防止低血钾的药物是氨苯蝶啶（E对）。异烟肼（A错）+链霉素+对氨基水杨酸或利福平加乙胺丁醇联合应用可延缓结核杆菌的耐药性。氢氯噻嗪与氨苯蝶啶合用可增强利尿作用，又可防止氢氯噻嗪引起低血钾。亚胺培南（B错）与棒酸合用，由于棒酸抑制β内酰胺酶，提高了亚胺培南的疗效。毒性哮喘时，β受体激动药沙丁胺醇（C错）与茶碱合用可得到相加的疗效。